方差分析中计算得到的F值
A. 一定小于0
B. 一定小于1
C. 一定等于0
D. 可以为负值
E. 一定为正值

正确答案：E。一定为正值